与利尿药合用治疗急性肾功能衰竭的药物是
A. 多巴胺
B. 去甲肾上腺素
C. 异丙肾上腺素
D. 5-羟色胺
E. 肾上腺素

正确答案：A。多巴胺

解析：多巴胺临床应用于治疗各种休克，如心源性休克、感染性休克和出血性休克等，尤其适用于伴有心肌收缩力减弱、尿量减少而血容量已补足的休克。此外，还可与利尿药等合用治疗急性肾功能衰竭（A对）。